以下哪项不是突发公共卫生事件的危害
A. 群体健康和生命严重受损
B. 造成心理伤害
C. 造成严重经济损失
D. 国家或地区形象受损及政治影响
E. 环境的破坏

正确答案：E。环境的破坏

解析：突发公共卫生事件的危害包括：①人群健康和生命严重受损；②造成心理伤害；③造成严重经济损失；④国家或地区形象受损及政治影响。掌握“突发公共卫生事件”知识点。